腹痛与下列哪项无关
A. 手三阴经
B. 足三阴经
C. 手少阳经
D. 足少阳经
E. 足阳明经

正确答案：C。手少阳经

解析：脐以上为大腹，属脾胃，为足太阴、足阳明经脉所主；脐以下为小腹，属肾、大小肠、膀胱、胞宫，为足少阴、手阳明、手足太阳经脉及冲、任、带所主；小腹两侧为少腹，属肝、胆，为足厥阴、足少阳经脉所过，手少阳经与腹部没有联系（C对BDE错）。手三阴经，从胸走手，与腹部关系联系较少，但第五版教材中已经明确提出其与腹部有关（A错）。